在奇经八脉中，其循环多次与手足三阳经及阳维脉交会的是
A. 冲脉
B. 任脉
C. 督脉
D. 阴维脉
E. 阳跷脉

正确答案：C。督脉

解析：本题考查奇经八脉的循行部位，属于记忆内容。督脉行于背部正中，其脉多次与手足三阳经及阳维脉相交会（C对）。